用于口腔黏膜消毒，冲洗伤口防止厌氧菌感染
A. 0.01%～0.1%硫柳汞
B. 1%硝酸银
C. 3%～6%过氧化氢
D. 含有0.2～0.5ppm氯
E. 生石灰

正确答案：C。3%～6%过氧化氢

解析：氧化剂：3%～6%过氧化氢，用于口腔黏膜消毒，冲洗伤口防止厌氧菌感染。0.2%～0.3%过氧乙酸，用于手及耐腐蚀物品消毒。掌握“消毒与灭菌”知识点。